根据《易制毒化学品管理条例》，第一类中的药品类易制毒化学品药品单方制剂
A. 不得零售
B. 由毒性药品定点经营企业经销
C. 由放射性药品定点经营企业经销
D. 由麻醉药品定点经营企业经销
E. 由精神药品定点经营企业经销

正确答案：A、D。不得零售；由麻醉药品定点经营企业经销

解析：本题考查药品类易制毒化学品的生产、经营许可。根据《易制毒化学品管理条例》，第一类中的药品类易制毒化学品药品单方制剂不得零售（A对）、由麻醉药品定点经营企业经销（D对）。药品类易制毒化学品的生产、经营许可：1.生产、经营药品类易制毒化学品的企业，应当依照有关规定取得药品类易制毒化学品生产、经营许可。未取得生产许可或经营许可的企业不得生产或经营药品类易制毒化学品。药品类易制毒化学品的生产许可，由企业所在地省级药品监督管理部门审批。药品类易制毒化学品以及含有药品类易制毒化学品的制剂不得委托生产。2.药品类易制毒化学品单方制剂和小包装麻黄素，纳入麻醉药品销售渠道经营，仅能由麻醉药品全国性批发企业和区域性批发企业经销，不得零售。未实行药品批准文号管理的品种，纳入药品类易制毒化学品原料药渠道经营。3.申请经营药品类易制毒化学品原料药的药品经营企业，应具有麻醉药品和第一类精神药品定点经营资格或者第二类精神药品定点经营资格，否则，药品监督管理部门将不予受理。